男，35岁。双下肢水肿2周。查体BP130/80mmHg，双下肢凹陷性水肿。尿常规蛋白（+++），红细胞（++）。血浆白蛋白28g/L，Scr78umol/L。尿蛋白定量3.6g/天。肾活检示肾小球系膜轻度增生，系膜区可见免疫复合物沉积。最可能的病理诊断
A. 局灶阶段性肾小球硬化
B. 系膜毛细血管性肾小球肾炎
C. 微小病变性肾病
D. 膜性肾病
E. 系膜增生性肾小球肾炎

正确答案：E。系膜增生性肾小球肾炎

解析：患者双下肢水肿2周，大量蛋白尿（尿蛋白定量3.6g/天，尿蛋白定量＞3.5g/d即为大量蛋白尿），低蛋白血症（血白蛋白28g/L，正常值＞30g/L），红细胞（++），提示肾病综合征。肾活检示肾小球系膜轻度增生，系膜区可见免疫复合物沉积，故最可能的病理诊断为系膜增生性肾小球肾炎（E对）。局灶节段性肾小球硬化（A错）光镜下可见病变呈局灶、节段分布，表现为受累节段的硬化（系膜基增多、毛细血管闭塞、球囊粘连等），相应的肾小管萎缩、肾间质纤维化。电镜下可见肾小球上皮细胞足突广泛融合、基底膜塌陷，系膜基质增多，电子致密物沉积（P472）。系膜毛细血管性肾小球肾炎（B错）光镜下较常见的病理改变为系膜细胞和系膜基质弥漫重度增生，可插入到肾小球基底膜（GBM）和内皮细胞之间，使毛细血管袢呈“双轨征”（P473）。微小病变型肾病（C错）光镜下肾小球基本正常，近曲小管上皮细胞可见脂肪变性。免疫病理检查阴性，特征性改变和本病的主要诊断依据为电镜下有广泛的肾小球脏层上皮细胞足突融合（P471）。膜性肾病（D错）光镜下可见肾小球弥漫性病变，早期仅于肾小球基底膜上皮侧见少量散在分布的嗜复红小颗粒，进而有钉突形成（嗜银染色），基底膜逐渐增厚（P472）。